下列关于白细胞分化抗原的描述正确的是
A. 淋巴细胞表面的膜分子
B. 主要为TCR和BCRE
C. 白细胞表面的全部膜分子
D. T淋巴细胞表面的膜分子
E. 白细胞处于不同分化阶段出现或消失的细胞表面标志分子

正确答案：E。白细胞处于不同分化阶段出现或消失的细胞表面标志分子

解析：白细胞分化抗原是指白细胞处于不同分化阶段出现或消失的细胞表面标志分子，现已采用CD分子命名。掌握“白细胞分化抗原及黏附分子”知识点。